牙根已发育完成，牙冠折断牙髓暴露者可使用
A. 安抚
B. 直接充填
C. 间接充填
D. 根管治疗
E. 根尖诱导成形术

正确答案：D。根管治疗

解析：牙根已发育完成，牙冠折断牙髓暴露者可应用根管治疗术，掌握“根管治疗术概述”知识点。